评价问卷所涉及的内容，能在多大程度上覆盖研究目的所要求达到的各个方面和领域的指标为
A. 复测信度
B. 复本信度
C. 准则效度
D. 内容效度
E. 折半信度

正确答案：D。内容效度